必须用X线片检查诊断的疾病是
A. 咬合面龋
B. 急性牙髓炎
C. 慢性牙髓炎
D. 急性根尖周炎
E. 慢性根尖周炎

正确答案：E。慢性根尖周炎

解析：本题考查慢性牙周炎的诊断要点。必须用X线片检查诊断的疾病是慢性根尖周炎（E对）。X线片上根尖区骨质破坏的影像是确诊慢性根尖周炎的关键依据。咬合面龋，视诊就可以诊断，无需用X线片检查（A错）。X线片主要用于检查牙体硬组织及牙槽骨的病变，对牙髓等软组织的检查并无意义，不能用于牙髓炎的检查（BC错）。急性根尖周炎，一般没有根尖周组织的破坏，X线检查无意义（D错）。